目前诊断肿瘤准确率最高的方法是
A. X线检查
B. 病理组织学
C. 放射性核素显像
D. 超声波检查
E. 免疫学检查

正确答案：B。病理组织学

解析：本题考查口腔颌面部肿瘤的诊断。目前诊断肿瘤准确率最高的方法是病理组织学（B对）。病理组织学系从病变部取一小块组织制成切片，在显微镜下观察细胞的形态和结构，以确定病变性质，肿瘤的类型及分化程度，此种方法准确可靠，可以及时提供诊断意见，供治疗时参考，准确率高，是临床上常用的诊断方法。X线检查（A错）不能够确定肿瘤的类型。放射性核素显像（C错）缺乏特异性，在定性诊断方面有一定的局限性。超声波检查（D错）只是临床诊断的辅助检查，不能够定性诊断。免疫学检查（E错）诊断肿方面，特异性不够，对于诊断肿瘤准确率不高。